阿司匹林哪组作用与相应机制不符
A. 解热作用是抑制中枢PG合成
B. 抗炎作用是抑制炎症部位PG合成
C. 镇痛作用主要是抑制中枢PG合成
D. 水杨酸反应是过量中毒表现
E. 预防血栓形成是抑制TXA₂＞PGI₂

正确答案：C。镇痛作用主要是抑制中枢PG合成